下列各项中，不属于缺铁性贫血中医证型的是
A. 脾胃虚弱证
B. 心脾两虚证
C. 热毒壅盛证
D. 脾肾阳虚证
E. 虫积证

正确答案：C。热毒壅盛证

解析：缺铁性贫血可由脾胃虚弱（A对），运化不利，水谷精微生成不足，气血生化乏源；或由心脾两虚（B对），则心不主血，脾虚不能统血故血溢脉外所致；或由脾肾阳虚（D对），肾不暖脾，运化不利，气血生成不足所致；或由虫积（E对）耗血而致贫血。病位主要在脾胃，与肝、肾有关，脾胃虚弱，运化失常，虫积及失血导致气血生化不足，是本病发生的基本病机（C错，为本题正确答案）。